胸锁关节
A. 是上肢骨与躯干骨连结的唯一关节
B. 关节囊松驰
C. 关节囊内无关节盘
D. 属平面关节
E. 无

正确答案：A。是上肢骨与躯干骨连结的唯一关节

解析：胸锁关节是上肢骨与躯干骨连结的唯一关节（A对），属于多轴关节（D错），关节囊坚韧（B错），并有多个韧带加强。关节囊内有关节盘（C错），将关节腔分为外上、内下两部分。